以下关于端生牙的说法正确的是
A. 端生牙有牙根
B. 端生牙凭借牙骨质附着于颌骨的边缘
C. 端生牙易脱落
D. 端生牙在爬行动物中常见
E. 端生牙在哺乳动物中可见

正确答案：C。端生牙易脱落

解析：端生牙：此类牙无牙根，仅借纤维膜附着于颌骨的边缘，易脱落。大部分硬骨鱼类为端生牙。掌握“牙的演化”知识点。